大血藤的主要化学成分是
A. 皂苷类化合物
B. 蒽醌类化合物
C. 黄酮类化合物
D. 生物碱类化合物
E. 内酯类化合物

正确答案：B。蒽醌类化合物